职业卫生与职业医学的主要任务是
A. 改善劳动条件
B. 提高劳动生产率
C. 消除不良因素，保护工人健康
D. 识别、评价、预测和控制不良劳动条件
E. 提高劳动卫生科学水平

正确答案：D。识别、评价、预测和控制不良劳动条件